呼吸衰竭最主要的临床表现是
A. 呼吸费力伴呼气延长
B. 呼吸频率增快
C. 呼吸困难与发绀
D. 神经精神症状
E. 双肺有大量湿啰音

正确答案：C。呼吸困难与发绀

解析：呼吸衰竭是指各种原因引起的肺通气和（或）换气功能严重障碍，使静息状态下亦不能维持足够的气体交换，导致低氧血症伴（或不伴）高碳酸血症，进而引起一系列病理生理改变和相应临床表现的综合征。临床表现主要是低氧血症所致的呼吸困难和多脏器功能衰竭，而发绀是缺氧的典型表现（C对）。呼吸费力伴呼气延长（A错）（P29）是支气管哮喘的典型临床表现。呼吸频率增快（B错）出现于急性呼吸衰竭早期及慢性呼吸衰竭加重时，是呼吸困难的临床表现之一。神经精神症状（D错）不是最主要的临床表现，只有在伴发肺性脑病后才会出现。双肺有大量湿啰音（E错）是急性左心衰的临床表现，不是呼吸衰竭的临床表现。